可使吗啡初显紫色渐转棕色的试剂是
A. 3，5-二硝基苯甲酸
B. 1%钒酸铵的浓硫酸溶液
C. 含少量甲醛的浓硫酸溶液
D. 1%钼酸钠的浓硫酸溶液
E. 饱和苦味酸试剂

正确答案：D。1%钼酸钠的浓硫酸溶液

解析：本题考查的是常用的生物碱显色剂。可使吗啡初显紫色渐转棕色的试剂是1%钼酸钠的浓硫酸溶液（D对）。生物碱显色反应：某些生物碱能与一些试剂反应生成不同颜色的产物，这些试剂称为生物碱显色剂。常用的生物碱显色试剂及颜色特征：①Mandelin试剂（1%钒酸铵的浓硫酸溶液（B错））：莨菪碱及阿托品显红色，吗啡显蓝紫色，可待因显蓝色，士的宁显蓝紫色，奎宁显淡橙色。②Macquis试剂（含少量甲醛的浓硫酸（C错））：吗啡显橙色至紫色，可待因显洋红色至黄棕色。③Frohde试剂（1%钼酸钠或钼酸铵的浓硫酸溶液）：吗啡显紫色渐转棕色，小檗碱显棕绿色，利血平显黄色渐转蓝色，乌头碱显黄棕色。3，5-二硝基苯甲酸（A错）试剂反应，即Kedde反应。为强心苷C-17位上不饱和内酯环的颜色反应，可使强心苷的甲醇或乙醇溶液呈红色或紫色。可用于强心苷纸色谱和薄层色谱显色剂，喷雾后显紫红色，几分钟后褪色。饱和苦味酸试剂（E错）为生物碱沉淀试剂。其组成为2，4，6-三硝基苯酚，可与生物碱形成黄色沉淀或结晶。